某医生观察某新药对预防流感的效果，发现未服药组流感发病率为28.013%，服药组为23.019%，则下列说法最合适的是
A. 服药组的发病率低于未服药组发病率，可以认为该药有效
B. 由于两组发病率相差不大，不能认为该药预防流感有效
C. 由于未设对照组，不能认为该药预防流感有效
D. 本资料应作假设检验后再作结论
E. 因为有抽样误差存在，不能得出结论

正确答案：D。本资料应作假设检验后再作结论